在某实验室中有以下药用辅料，可以用作片剂填充剂的有
A. 可压性淀粉
B. 微晶纤维素
C. 交联羧甲基纤维素钠
D. 硬脂酸镁
E. 糊精

正确答案：A、B、E。可压性淀粉；微晶纤维素；糊精

解析：本题考查片剂的常用辅料。可压性淀粉（A对）、微晶纤维素（B对）、糊精（E对）可以用作片剂的填充剂。稀释剂即填充剂，是片剂的常用辅料。由于一些药物的剂量有时只有几毫克甚至更少，不适于片剂成型及临床给药，因此凡主药剂量小于50毫克时需要加入一定剂量的填充剂。理想的填充剂应具有化学惰性和生理学惰性，且不影响药物有效成分的生物利用度。例如，淀粉（性质稳定、吸湿性小，但可压性较差）、糊精（较少单独使用，多与淀粉、蔗糖等合用）、可压性淀粉（具有良好的可压性、流动性和自身润滑性）。交联羧甲基纤维素钠（C错）在片剂中用作崩解剂。硬脂酸镁（D错）是片剂中常用的润滑剂。